根据《医疗机构制剂配制质量管理规范（试行）》，制剂收回记录的内容不包括
A. 制剂名称
B. 制剂工艺
C. 制剂批号
D. 收回部门
E. 处理意见

正确答案：B。制剂工艺

解析：本题考查的是医疗机构配制制剂收回记录的内容。根据《医疗机构制剂配制质量管理规范（试行）》，制剂收回记录的内容不包括制剂工艺（B错，为本题正确答案）。收回记录应包括：制剂名称（A对）、批号（C对）、规格、数量、收回部门（D对）、收回原因、处理意见（E对）及日期等。